通过测定血浆Na⁺、CI-、HCO₃⁻可以计算
A. SB
B. AB
C. BE
D. AG
E. BB

正确答案：D。AG

解析：通过测定血浆Na⁺、CI-、HCO₃⁻可以计算AG（D对）。